自然疫源性疾病是指
A. 病原体能通过动物传播到人的疾病
B. 以动物为传染源的疾病
C. 一种疾病的病原体，不依靠人而能在自然界里产生动物中生存繁殖，并在一定条件下传给人和家畜。
D. 在自然界中自生自灭的疾病

正确答案：C。一种疾病的病原体，不依靠人而能在自然界里产生动物中生存繁殖，并在一定条件下传给人和家畜。

解析：本题考查自然疫源性疾病。自然疫源性疾病是指一种疾病的病原体，不依靠人而能在自然界里产生动物中生存繁殖，并在一定条件下传给人和家畜（C对ABD错）。